传染性非典型肺炎主要传播途径是
A. 飞沫
B. 血液
C. 性接触
D. 消化道
E. 母婴

正确答案：A。飞沫

解析：传染性非典型肺炎主要传播途径是通过飞沫传播（A对）。艾滋病、梅毒等可通过血液（B错）、性接触（C错）、母婴（E错）传播。甲型肝炎等可通过消化道传播（D错）。